某男，56岁，患高血压病服用吲达帕胺，后因血压控制不理想，自行加服珍菊降压片。近期感觉胸闷、心悸、乏力。到医院就诊。医师认为患者出现的症状与其自行加服珍菊降压片有关。珍菊降压片和吲达帕胺合用，最常见的不良反应是
A. 低血糖
B. 血小板减少
C. 低蛋白
D. 低血钾
E. 白细胞减少

正确答案：D。低血钾

解析：本题考查的是中成药不良反应。珍菊降压片和吲达帕胺合用，最常见的不良反应是低血钾（D对）。珍菊降压片含西药成分：盐酸可乐定、氢氯噻嗪。珍菊降压片和吲达帕胺均为降压药，为重复用药。含氢氯噻嗪的中成药的使用注意：氢氯噻嗪引起的不良反应最常见为低血钾，同时因其可抑制胰岛素释放，可使糖耐量降低、血糖升高，故肝肾疾病、糖尿病患者，孕妇及哺乳期妇女不宜服用。所以，使用含有氢氯噻嗪的中成药时，一方面要注意氢氯噻嗪本身所具有的不良反应，同时也要避免重复用药，以防止药物自身不良反应的发生。低血糖（A错）为含乙醇中成药与胰岛素及磺脲类降糖西药联用的不良反应。含乙醇的中成药如各种药酒等，不可与胰岛素及磺脲类降糖西药同用或同服。因联用后会导致严重的低血糖，或头晕、呕吐，严重者可出现昏睡等酩酊反应，甚至出现不可逆性神经系统症状等。血小板减少（B错）为长期使用含安乃近成分的中药的不良反应。含安乃近成分的中药的使用注意：安乃近多用于急性高热时退热，其退热作用强，易致患者大汗淋漓，甚至发生虚脱。长期应用可能引起粒细胞缺乏症、血小板减少性紫癫、再生障碍性贫血。因此，在服用含有安乃近成分的中成药时，切不可随意加大剂量，更不能长期使用，年老体弱者用药尤其应慎重，不能再同时加用西药解热药。因安乃近的代谢产物可进入乳汁，故哺乳期患者不宜应用。对安乃近、氨基比林及阿司匹林类药物过敏者禁用。低蛋白（C错）为蓖麻子的不良反应表现。蓖麻子的不良反应表现：蓖麻毒素经呼吸道吸入、消化道摄入和肌内注射均可致人中毒，潜伏期一般为4～8小时，临床主要表现如下。①消化系统：口麻、咽部烧灼感、恶心、呕吐、腹痛、腹泻、出血性胃肠炎，黄疸以及中毒性肝病等。②呼吸、循环系统：呼吸、循环衰竭。③网状内皮系统：严重脱水、低蛋白血症、水肿、毒血症、高热。④血液、泌尿系统：溶血；血便、血尿、少尿、尿闭等中毒性肾病。⑤神经系统：四肢麻木、步态不稳、烦躁不安、精神错乱、手舞足蹈、昏迷、幻觉、癫痫样发作。⑥有时可伴发过敏反应如口唇青紫、荨麻疹。白细胞减少（E错）为维C银翘片的不良反应表现。维C银翘片的不良反应表现：皮肤及附属器损害，表现为全身皮疹伴瘙痒、严重荨麻疹、重症多形红斑型药疹、大疱性表皮松解症；消化系统损害，表现为肝功能异常；全身性损害，表现为过敏性休克、过敏样反应、昏厥；泌尿系统损害，表现为间质性肾炎；血液系统损害，表现为白细胞减少、溶血性贫血。